氨基酸评分可以确定蛋白质的
A. 生物利用率
B. 真实消化率
C. 蛋白质含量
D. 必需氨基酸
E. 限制氨基酸

正确答案：E。限制氨基酸